患者女，16岁，上呼吸道感染后发生心悸，胸闷，气短，胸部X线片示心脏扩大，肺淤血证，诊断为病毒性心肌炎、心功能不全。缓解心功能不全首选的药物是
A. 钙离子拮抗剂
B. 激素
C. 利尿剂
D. 血管扩张剂
E. 洋地黄

正确答案：D。血管扩张剂

解析：血管扩张剂可以降低心室前后负荷，缓解肺瘀血（D对）；钙离子拮抗剂，是一类可以选择性的阻滞，钙离子经减压细胞流入降低细胞内钙离子浓度。在一般的临床工作中，主要用于降低血压以及治疗不稳定性冠心病、心绞痛等等（A错）；激素在病毒性心肌炎最初发病10天内，一般不必运用，因激素可抑制干扰素的合成和释放，促进病毒繁殖和引起感染加重（B错）；利尿剂能够消除水钠储留减轻心脏负荷，是治疗心功能不全的常用药物，但不能单独使用，可以与强心药或血管扩张药合用（C错）；对于中、重度以收缩功能不全为主的，尤其伴有快速房颤的收缩性心力衰竭的患者，考虑给予强心药，如洋地黄类药物（E错）。